谷类蛋白质中含赖氨酸较低的蛋白质组分是
A. 谷蛋白＋清蛋白
B. 清蛋白＋醇溶蛋白
C. 球蛋白＋清蛋白
D. 醇溶蛋白＋谷蛋白
E. 清蛋白＋谷蛋白＋醇溶蛋白

正确答案：D。醇溶蛋白＋谷蛋白